下列关于内生肌酐清除率的叙述，正确的是
A. 肾功能严重损害时，开始升高
B. 高于80mL/min提示预后不良
C. 肾功能损害越重，其清除率越低
D. 肾功能损害越重，其清除率越高
E. 与肾功能损害程度无关

正确答案：C。肾功能损害越重，其清除率越低

解析：肌酐是肌酸的代谢产物，在成人体内含肌酐约100g，其中98%存在于肌肉，每天约更新2%，人体血液中肌酐的生成可有内、外源性两种，如在严格控制饮食条件和肌肉活动相对稳定的情况下，血浆肌酐的生成量和尿的排出量较恒定，其含量的变化主要受内源性肌酐的影响，而且肌酐大部分是从肾小球滤过，不被肾小管重吸收，排泌量很少，故肾单位时间内，把若干毫升血浆中的内生肌酐全部清除出去，称为内生肌酐清除率（Ccr）。根据Ccr一般可将肾衰竭分为4期：第1期（代偿期）Ccr为51～80mL/min；第2期（失代偿期）Ccr为50～20mL/min；第3期（肾衰竭期）Ccr为19～10mL/min；第4期（尿毒症期或终末期肾衰竭）Ccr<10mL/min。故肾功能损害越重，其清除率越低（C对ADE错）。内生肌酐清除率越低，提示预后不良，而不是高于80mL/min提示预后不良（B错）。